FA由血液中何种物质运输
A. CM
B. LDL
C. HDL
D. 清蛋白
E. 球蛋白

正确答案：D。清蛋白